呈长倒卵形，略弯曲，有的纵剖为两半；表面黄棕色至黑褐色，密被排列整齐的柄残基及鳞片的药材是
A. 大黄
B. 葛根
C. 天麻
D. 绵马贯众
E. 地黄

正确答案：D。绵马贯众

解析：本题考查的是绵马贯众的性状鉴别。呈长倒卵形，略弯曲，有的纵剖为两半；表面黄棕色至黑褐色，密被排列整齐的柄残基及鳞片的药材是绵马贯众（D对）。绵马贯众【性状鉴别】药材呈长倒卵形，略弯曲，上端钝圆或截形，下端较尖，有的纵剖为两半，长7～20cm，直径4～8cm。表面黄棕色至黑褐色，密被排列整齐的叶柄残基及鳞片，并有弯曲的须根。大黄（A错）【性状鉴别】药材呈类圆柱形、圆锥形、卵圆形或不规则块片状，长3～17cm，直径3～10cm。除尽外皮者表面黄棕色至红棕色，有的可见类白色网状纹理及“星点”（异型维管束）散在，残留的外皮棕褐色，多具绳孔及粗皱纹。葛根（B错）【性状鉴别】药材呈纵切的长方形厚片或小方块，长5～35cm，厚0.5～1cm。外皮淡棕色至棕色，有纵皱纹，粗糙。切面黄白色至淡黄棕色，有的纹理不明显。天麻（C错）【性状鉴别】药材呈椭圆形或长条形，略扁，皱缩而稍弯曲，长3～15cm，宽1.5～6cm，厚0.5～2cm。表面黄白色至淡黄棕色，有纵皱纹及由潜伏芽排列而成的横环纹多轮，有时可见鳞叶或棕褐色菌索。地黄（E错）【性状鉴别】药材鲜地黄：呈纺锤形或条状，长8～24cm，直径2～9cm。外皮薄，表面浅红黄色，具弯曲的纵皱纹、芽痕、横长皮孔样突起以及不规则瘢痕。